在开展学校健康教育活动前，收集信息，了解基本情况，为确定教育的目标、步骤和方法提供科学依据属于哪种类型的评价
A. 需求评价
B. 过程评价
C. 近期效应评价
D. 远期效应评价
E. 结局评价

正确答案：A。需求评价